某男，58岁，患肝虚目暗5年，近日又患肝热目赤、羞明多泪。治当清热养肝明目，宜选用的药是
A. 大血藤
B. 野菊花
C. 密蒙花
D. 金荞麦
E. 土茯苓

正确答案：C。密蒙花

解析：本题考查密蒙花的功效。某男，58岁，患肝虚目暗5年，近日又患肝热目赤、羞明多泪。治当清热养肝明目，宜选用的药是密蒙花（C对）。密蒙花【功效】清热养肝，明目退翳。大血藤（A错）【功效】清热解毒，活血止痛，祛风通络。野菊花（B错）【功效】清热解毒，疏风平肝。金荞麦（D错）【功效】清热解毒，祛痰排脓，散瘀止痛，健脾除湿。土茯苓（E错）【功效】解毒，利湿，通利关节。